流行过程的基本条件是
A. 患者病原携带者受感染的动物
B. 周围性地区性季节性
C. 传染源传播途径易感人群
D. 散发流行暴发流行
E. 自然因素社会因素

正确答案：C。传染源传播途径易感人群

解析：流行过程的发生需要有三个基本条件，包括传染源、传播途径和人群易感性（B对）。